应用卡马西平可治疗
A. 原因不明头痛
B. 三叉神经痛
C. 紧张和焦虑性头痛
D. 反复性偏头痛
E. 丙酮与乳酸堆积的头痛

正确答案：B。三叉神经痛

解析：本题考查卡马西平。卡马西平是一种常见精神性药物，可用于缓解三叉神经痛（B对）；原因不明的头痛（A错）不能确定疼痛来源，无法正确用药；紧张和焦虑性头痛（C错）可用地西泮治疗；反复性偏头痛（D错）可用麦角胺咖啡因治疗；丙酮与乳酸堆积的头痛（E错）可用维生素B₁治疗。